下列不属于拔牙禁忌证的是
A. 频发心绞痛
B. 充血性心功能衰竭
C. 双束支传导阻滞者
D. 未控制的心律不齐
E. 8个月前发生过心肌梗死

正确答案：E。8个月前发生过心肌梗死

解析：本题考查拔牙的禁忌证。心脏病是拔牙常见禁忌症，一般而言，心脏病患者如心功能尚好，为Ⅰ或Ⅱ级，可以耐受拔牙及其他口腔小手术，但有以下情况者应视为拔牙禁忌症：有近期（6个月内）心肌梗死病史者（E错，为本题的正确答案）；频发心绞痛（A对）；充血性心功能衰竭（B对）；有三度或二度Ⅱ型房室传导阻滞、双束支传导阻滞者（C对）；未控制的心律不齐（D对）；心功能Ⅲ～Ⅳ级者。